椎骨
A. 一般由椎体和椎弓组成
B. 颈椎均有椎体
C. 第7颈椎又称寰椎
D. 胸椎的横突有孔
E. 无

正确答案：A。一般由椎体和椎弓组成

解析：椎骨一般由椎体和椎弓组成（A对）。第 1 颈椎又名寰椎, 呈环状，无椎体（B错）、棘突和关节突（C错）。颈椎横突有孔，称横突孔 , 有椎动脉和椎静脉通过（D错）。